下列大疱性疾病中会危及生命的是
A. 瘢痕性类天疱疮
B. 寻常型天疱疮
C. 大疱性类天疱疮
D. 多形性类天疱疮
E. 大疱性扁平苔癣

正确答案：B。寻常型天疱疮

解析：本题考查会危及生命的大疱性疾病。寻常型天疱疮（B对）累及皮肤时皮肤不断出现性的水疱，由于大量失水、电解质和蛋白质从疱夜中消耗，患者出现恶病质，常并发感染。若反复发作，不能及时有效控制病情，可因感染而死亡。瘢痕性类天疱疮（A错）慢性迁延，但预后良好，眼部形成瘢痕可致失明。大疱性类天疱疮（C错）预后良好可复发。多形性类天疱疮（D错）预后较好。大疱性扁平苔癣（E错）预后较好可复发。